关于一期梅毒的叙述错误的是
A. 有不洁性交史
B. 可出现硬下疳
C. 梅毒血清学阴性
D. 有心血管梅毒
E. 外阴表面溃疡，有浆液性渗出

正确答案：D。有心血管梅毒